下列哪项是宫颈癌Ⅰ期的主要表现
A. 肿瘤局限于宫颈（累及宫体可以被忽略）
B. 癌灶已超出宫颈，但未达盆壁
C. 癌累及阴道，但未达阴道下1/3
D. 癌播散超出真骨盆或癌浸润膀胱黏膜及直肠黏膜
E. 有肾盂积水

正确答案：A。肿瘤局限于宫颈（累及宫体可以被忽略）

解析：Ⅰ期：肿瘤灶局限于宫颈（累及宫体可以被忽略）。掌握“宫颈癌”知识点。